属于下运动神经元的是
A. 大脑皮质传出神经元
B. 脊髓后角神经元
C. 小脑皮质传出神经元
D. 脑神经运动核
E. 无

正确答案：D。脑神经运动核

解析：下运动神经元为脑神经一般躯体和特殊内脏运动核（D对）和脊髓前角的运动神经细胞组成。所以属于下运动神经元的是脑神经运动核。脊髓后角神经元（B错）为感觉性神经元，参与人体的感觉。